经任何给药途径给予一定剂量的药物后到达全身血液循环内药物的百分率称为
A. 体内药物总量
B. 半数有效量
C. 治疗指数
D. 用药剂量
E. 生物利用度

正确答案：E。生物利用度

解析：经任何给药途径给予一定剂量的药物后到达全身血液循环内药物的百分率称生物利用度。掌握“药物消除及重要参数”知识点。